一项以医院为基础的罕见病的病例对照研究，其符合规定的病例数很少且病例的某种构成特殊，不易找到均衡的对照组，但又必须保证研究效率。选择易找到且常用对照来源为
A. 全人群的无偏样本
B. 产生病例的人群中全体未患此病的人
C. 同一医院诊断的其他系统疾病的病例
D. 社区人口中的健康人
E. 病例的同胞，同事等

正确答案：C。同一医院诊断的其他系统疾病的病例